高血压患者动脉壁可见的可逆性损害常表现为
A. 细胞水肿
B. 脂肪变
C. 玻璃样变
D. 淀粉样变
E. 黏液样变

正确答案：C。玻璃样变

解析：高血压患者的主要病变特征是细小动脉硬化，表现为动脉壁玻璃样变（C对），玻璃样变为可逆性损害，去除病因后可恢复正常。细胞水肿（A错）、脂肪变（B错）、淀粉样变（D错）和黏液样变（E错）虽也均为可逆性损害，但不常见于高血压患者。